某研究者为探讨脂肪摄入量与男性前列腺癌的关系，在社区内选择高脂肪和低脂肪摄入者各200名，从50岁开始对他们进行随访10年。在随访期间，高脂肪摄入组中有20人，低脂肪摄入者中有10人被诊断为前列腺癌。与低脂肪摄入组相比，高脂肪摄入组的前列腺癌的相对危险度（RR）是
A. 1.5
B. 0.75
C. 1
D. 2
E. 0.05

正确答案：D。2

解析：在队列研究中，相对危险度是反映暴露与发病的关联强度最有用的指标。依据上述公式计算：相对危险度RR=暴露组发病率/非暴露组发病率=（20/200）/（10/200）=2（D对）。